形成病因假设的一种方法是“求同法”，例如
A. 某学校发生食物中毒，患者均为进食某项食品者，不进该食品者不发病，因而该项食品为可疑病因
B. 某市发生散发食物中毒多起，经调查患者均有进食某熟食店某熟食史，因而该熟食为可疑病因
C. 某厂供应的学生午餐饭盒，供应若干学校，各校用餐人数不等，用餐多的学校食物中毒发生人数多，该厂盒饭为可疑病因
D. 某厂供应相同的午餐饭盒给若干学校，仅一个学校发生食物中毒，经调查食物中毒发生在该校自供午餐的班级，因而该厂盒饭并非病因
E. 某市发生食物中毒多起，经化验大多由同一病原微生物所致

正确答案：B。某市发生散发食物中毒多起，经调查患者均有进食某熟食店某熟食史，因而该熟食为可疑病因

解析：本题考查求同法。形成病因假设的一种方法是求同法，例如某市发生散发食物中毒多起，经调查患者均有进食某熟食店某熟食史，因而该熟食为可疑病因（B对ACDE错）。求同法认为，考察某现象如果各个不同场合除一个条件相同外（进食史），其他条件都不同，那么，这个相同的条件（进食史）可能就是某研究现象的原因。